女，17岁。因学习压力大，成绩下降，近1个月每天上学至校门口时感到紧张、害怕，发生喷射性呕吐，将早餐尽数呕吐出，消化科检查未发现异常，体重无明显下降，请病假在家时从不呕吐，进食亦无异常。该患者最有可能的诊断是
A. 应激相关障碍
B. 神经性呕吐
C. 特定性呕吐
D. 社交恐惧症
E. 惊恐障碍

正确答案：B。神经性呕吐

解析：女，17岁。因学习压力大，成绩下降，近1个月每天上学至校门口时感到紧张、害怕，发生喷射性呕吐，将早餐尽数呕吐出，消化科检查未发现异常，体重无明显下降，请病假在家时从不呕吐，进食亦无异常。神经性呕吐以反复发作进食后呕吐为主要特征，无明显恶心及其他不适。呕吐常呈喷射状。该患者最有可能的诊断是神经性呕吐（B对）。应激相关障碍，特定性呕吐喷射性呕吐多不明显（AC错）。惊恐障碍指反复的，有事为不可预料的焦虑或恐惧发作突如其来，喷射性呕吐不明显（E错）。社交恐惧症以过分和不合理地惧怕外界某种客观事物或情景为主要表现，患者明知这种恐惧反应是过分的或不合理的，但仍反复出现，难以控制。一般不会出现喷射性呕吐（D错）。